滑石配生甘草的功效有
A. 利水
B. 清肝明目
C. 凉血止血
D. 清解暑热
E. 清热排脓

正确答案：A、D。利水；清解暑热

解析：本题考查滑石的配伍。滑石配生甘草的功效有利水（A对）、清解暑热（D对）。滑石【配伍】滑石配生甘草：滑石甘淡性寒，功能清暑利尿；生甘草甘平偏凉，功能清热解毒、益气和中。两药相配，既清解暑热，又利水而不伤津，主治暑湿身热烦渴。菊花【配伍】菊花配枸杞子：菊花辛甘微寒，功能清肝明目（B错）、益阴平肝；枸杞子甘平，功能滋补肝肾、明目。两药相配，补肝肾明目力强，善治肝肾亏虚之视物昏花，兼风热或肝热者尤宜。青黛【配伍】青黛配海蛤壳：青黛咸寒，功能清肝火、解热毒、凉血而止血；海蛤壳苦寒清泄，咸软质重，功能清热化痰、利尿。两药相配，既清肝火而化痰，又凉血止血（C错），治肝火扰肺之咳痰黏稠、色黄带血。鱼腥草【配伍】鱼腥草配桔梗：鱼腥草辛香宣散，微寒能清，功能清解热毒、排脓消痈；桔梗辛散苦泄轻浮，性平少偏，专入肺经，功能宣肺祛痰、利咽止咳、排脓。两药相配，清热宣肺、祛痰止咳、利咽排脓（E错），治肺痈咳吐脓血、肺热咳嗽痰稠可投。